患者，女，50岁，已婚。月经紊乱3年余，间隔10天左右或2~3个月一潮，量不多，淋漓数十天不止，色鲜红、质稍稠，头晕耳鸣，腰膝痠软，时或心烦口干，舌红少苔，脉细数。妇检、B型超声波检查无异常，子宫内膜检查为“囊腺型增生过长”，其诊断是
A. 无排卵型功血，肾阴虚型崩漏
B. 无排卵型功血，血热型崩漏
C. 无排卵型功血，肝热型崩漏
D. 排卵型功血，肾阴虚型经期延长
E. 排卵型功血，血热型经期延长

正确答案：A。无排卵型功血，肾阴虚型崩漏

解析：无排卵性功血是由于调节生殖的神经内分泌系统功能紊乱所导致的不规则子宫出血，多见于青春期和更年期。患者年龄50岁，已过“七七”之年，月经紊乱三年，是为经期延长，并符合无排卵性功血症状（DE错）。肾阴不足冲任失调，上不能荣头目脑窍，故头晕耳鸣，下不能荣养腰府，故腰膝酸软，心烦口干，舌红少苔，脉细数是为阴虚之证。患者月经量不多，但淋漓不止十余天，故诊断为漏下，即属崩漏之证（A对）。虚热型崩漏多见面颊潮红，烦热少寐，咽干口燥，便结，舌红少苔，脉细数等虚热之证。实热型崩漏多见经血色深红，质稠；口渴烦热，便秘溺黄；舌红、苔黄、脉滑数等实热之证（B错）。崩漏肝热型多伴见胸胁胀痛，或飧泄，面青，手足冷，叹气，脉弦沉（C错）。